唐氏综合征患儿最多见的畸形
A. 先天性心脏病
B. 唇裂
C. 消化道畸形
D. 隐睾
E. 神经管畸形

正确答案：A。先天性心脏病

解析：唐氏综合征患儿最多见的畸形先天性心脏病（A对），约占50%，其次是消化道疾病（C错）。部分男孩有隐睾（D错），唇裂（B错）、神经管疾病（E错）较少见。